在下述指标中，对于制定食品中有毒有害物质限量标准的程序，需要考虑安全系数才能计算得出的是
A. 最大无作用剂量
B. 人体每日容许摄入量
C. 总膳食中的容许含量
D. 每种食物中的最大容许量
E. 食品中有毒物质限量

正确答案：B。人体每日容许摄入量